患者，男，因哮喘就诊。医生开具丙酸氟替卡松吸入气雾剂控制哮喘症状，建议使用2周，换用激素药物会产生全身性糖皮质激素副作用，就此咨询药师。依据丙酸氟替卡松的结构和制剂的特点，对患者咨询问题的科学解释是
A. 丙酸氟替卡松没有糖皮质激素样作用
B. 丙酸氟替卡松气雾剂中有拮抗激素作用的药物，能避免产生全身性糖皮质激素副作用
C. 丙酸氟替卡松体内不发生代谢，用药后很快从尿中排出，能避免产生全身性糖皮质激副作用
D. 丙酸氟替卡松结构中16位甲基易氧化，失去活性，能避免产生全身性糖皮质激素副作用
E. 丙酸氟替卡松结构中17位β羧酸酯具有活性，在体内水解产生的β羧酸失去活性，能避免产生全身性糖皮质激素副作用

正确答案：E。丙酸氟替卡松结构中17位β羧酸酯具有活性，在体内水解产生的β羧酸失去活性，能避免产生全身性糖皮质激素副作用

解析：本题考查糖皮质激素类平喘药。丙酸氟替卡松是用于控制哮喘症状的糖皮质激素药物，其分子结构中存在17位β羧酸的衍生物。由于仅17位β羧酸酯衍生物具有活性，而β羧酸衍生物不具活性，故丙酸氟替卡松经水解可失活，能避免皮质激素的全身作用。同时，由于上述性质，丙酸氟替卡松具有气道局部较高的抗炎活性和较少的全身副作用，成为治疗哮喘的吸入药物（E对）。